依法实行许可证管理的药事活动不包括
A. 药品研究
B. 药品生产
C. 药品批发
D. 药品零售
E. 医院制剂

正确答案：A。药品研究

解析：本题考查的是药品行政许可事项。依法实行许可证管理的药事活动不包括药品研究（A错，为本题正确答案）。药品行政许可事项：根据《药品管理法》《药品管理法实施条例》《麻醉药品和精神药品管理条例》等法律、行政法规以及其他设定行政许可的相关法律依据，国家对药品注册、安全监管与稽查设定了一系列行政许可项目。如：药品上市许可，表现形式为颁发药品注册证书；药品生产许可，表现形式为颁发《药品生产许可证》（B对）和《医疗机构制剂许可证》（E对）；药品经营许可，表现形式为颁发《药品经营许可证》（CD对）；国务院行政法规确认了执业药师执业许可，表现形式为颁发《执业药师注册证》。